表面紫红色或红褐色，有致密的纹理，质硬，有油性的是
A. 沉香饮片
B. 大血藤饮片
C. 降香饮片
D. 苏木饮片
E. 通草饮片

正确答案：C。降香饮片

解析：本题考查的是中药饮片的性状鉴别。表面紫红色或红褐色，有致密的纹理，质硬，有油性的是降香饮片（C对）。降香：【性状鉴别】饮片为不规则的薄片、小碎块或细粉。表面紫红色或红褐色，切面有致密的纹理。质硬，有油性。气微香，味微苦。沉香（A错）：【性状鉴别】饮片呈不规则片状、长条形或类方形小碎块状。表面凹凸不平，有的有刀削痕，偶有孔洞，可见黑褐色树脂与黄白色木部相间的斑纹。质较坚实，刀削面平整，折断面刺状。气芳香，味苦。大血藤（B错）：【性状鉴别】饮片呈类椭圆形的厚片。外表皮灰棕色、粗糙。切面皮部红棕色，有数处向内嵌入木部，木部黄白色，有多数导管孔，射线呈放射状排列。气微，味微涩。苏木（D错）：【性状鉴别】饮片呈细条状、不规则片状，或为粗粉。片、条表面黄红色至棕红色，常见纵向纹理。质坚硬。有的可见暗棕色、质松、带亮星的髓部。气微，味微涩。通草（E错）：【性状鉴别】饮片呈圆形的厚片或小段，表面有银白色光泽。髓部中空或有半透明的薄膜，体轻，质松软，有弹性。气微，味淡。